主要表现为以下颌支及下颌角为中心的咬肌区肿胀、充血、压痛，伴明显开口受限的间隙感染是
A. 咬肌间隙感染
B. 眶下间隙感染
C. 下颌下间隙感染
D. 翼下颌间隙感染
E. 颞下间隙感染

正确答案：A。咬肌间隙感染

解析：咬肌间隙感染的典型症状是以下颌支及下颌角为中心的咬肌区肿胀、充血、压痛，伴明显开口受限。掌握“翼下颌间隙、颞下间隙感染”知识点。